下列阻生牙拔除的适应证中，不包括
A. 预防阻生牙本身及第二磨牙近远中邻面的龋坏
B. 反复引起冠周炎
C. 正畸需要拔除
D. 阻生牙本身有龋坏并引起邻牙病变者
E. 可能成为颞下颌关节病的病因

正确答案：A。预防阻生牙本身及第二磨牙近远中邻面的龋坏

解析：下颌第三磨牙通常为近中倾斜阻生，所以易致第二磨牙远中邻面龋坏，不是近远中。掌握“阻生牙拔除术”知识点。